牙髓的增龄性变化中，牙髓血管中的变化中会出现
A. 胆固醇沉积
B. 血管扩张
C. 血管收缩
D. 血栓形成
E. 血管坏死

正确答案：A。胆固醇沉积

解析：随着年龄的增长，牙髓血管中可出现机体其它部位出现的胆固醇沉积，可使管壁黏附性增强并引起局部炎症反应，进而导致牙髓活力降低，出现退行性变。掌握“牙髓”知识点。